下列唇裂整复术术前准备中哪项是不需要的
A. 术前必须进行全面体检
B. 术前3天开始练习用汤匙或滴管喂饲流质或母乳
C. 术前1天做局部皮肤准备
D. 术前3天开始预防性服用抗生素
E. 术前30分钟注射阿托品

正确答案：D。术前3天开始预防性服用抗生素

解析：本题考查唇裂整复术的术前准备。唇裂整复术是一种要求极高的手术，手术效果的优劣会直接影响患者的身心健康与生存质量，故需精心准备，制定周密的手术计划，方可获得手术成功。应在术前0.5～1小时开始预防性服用抗生素（D错，为本题的正确答案）以提高手术疗效，降低术后并发症的发生率。术前必须进行全面体检（A对），对全身或局部出现的异常情况，均应查明原因，并给予适当治疗，待恢复正常后才可安排手术。术前3天开始练习用汤匙或滴管喂饲流质或母乳（B对），以使患儿能适应术后饮食方式，保证患儿摄入充足营养。术前1天作局部皮肤准备（C对），可用肥皂水清洗上下唇及鼻部，并用生理盐水擦洗口腔。术前30分钟注射阿托品（E对）可达到缓解疼痛的目的。